深龋治疗时为避免露髓，保留洞底近髓部分龋坏牙本质应采用
A. 间接盖髓术
B. 直接盖髓术
C. 氢氧化钙活髓切断术
D. FC（戊二醛）断髓术
E. 根管治疗术

正确答案：A。间接盖髓术

解析：间接盖髓术：深龋治疗时为避免露髓，保留洞底近髓部分龋坏牙本质，应用氢氧化钙制剂间接盖髓，抑制龋齿进展，促进修复性牙本质形成，保存牙髓活力。掌握“乳牙牙髓病及根尖周病诊断及治疗”知识点。